偏头痛的预防治疗药物是
A. 咖啡因麦角胺
B. 英明格
C. 苯噻啶
D. 小剂量阿司匹林
E. 消炎痛

正确答案：C。苯噻啶

解析：偏头痛的药物性治疗分为发作期治疗和预防性治疗。预防性治疗药物包括β肾上腺素能受体阻滞剂、钙离子拮抗剂、抗癫痫药、抗抑郁药和以苯噻啶（C对）为代表的5-HT受体拮抗剂。发作期治疗药物包括非特异性止痛药和阿片类药物。咖啡因麦角胺（A错）、英明格（B错）均属于阿片类药物；小剂量阿司匹林（D错）、消炎痛（E错）属于非特异性止痛药。ABDE均为发作期治疗药物。